中医学中“证”的确切含义是
A. 疾病的症状
B. 疾病的病机
C. 疾病发展过程中某阶段的病理概括
D. 疾病的病名
E. 疾病的体征

正确答案：C。疾病发展过程中某阶段的病理概括

解析：本题考查的是症、证、病的概念。中医学中“证”的确切含义是疾病发展过程中某阶段的病理概括（C对）。症，指疾病的外在表现，即症状（A错）。病（D错），即疾病的简称，指有特定的致病因素、发病规律和病机（B错）演变的异常生命过程，具有特定的症状和体征（E错）。所谓“证”，是机体在疾病发展过程中某一阶段的病机概括，包括病变的部位、原因、性质以及邪正关系，能够反映出疾病发展过程中某一阶段的病机变化的本质，因而它比症状能更全面、更深刻、更准确地揭示出疾病的发展过程和本质。